治水火烫伤的成药属
A. 外科用药
B. 内科用药
C. 骨伤科用药
D. 皮肤科用药
E. 五官科用药

正确答案：A。外科用药